患儿，2个月。出生时出现黄疸，日益加深，色呈黄褐，腹部胀满，右胁痞块质硬。治疗应首选
A. 茵陈蒿汤
B. 茵陈五苓散
C. 茵陈理中汤
D. 木香槟榔丸
E. 血府逐瘀汤

正确答案：E。血府逐瘀汤

解析：患儿出生后出现黄疸，当属胎黄，其以婴儿出生后皮肤面目出现黄疸为特征，为气机不畅，肝胆失常，络脉瘀积而致，可见黄色晦暗，若伴肚腹胀满，右胁痞块质硬，治以血府逐瘀汤，可化瘀消积（E对）。茵陈蒿汤适于湿热郁蒸的胎黄，症见面目皮肤发黄，色泽鲜明如橘，或有发热，大便秘结，小便深黄，舌质红，苔黄腻（A错）。茵陈五苓散适于湿重于热的黄疸，小便不利者（B错）。茵陈理中汤适于寒湿阻滞的胎黄，症见面目皮肤发黄，色泽晦暗，四肢欠温，大便稀薄灰白，小便短少，舌质淡，苔白腻（C错）。木香槟榔丸用于湿热内停，赤白痢疾，里急后重，胃肠积滞，脘腹胀痛，大便不通者（D错 ）。